男孩，7岁，近年来多次从睡眠中惊吓醒来，表情恐惧，呼吸急促，出汗，持续数分钟，对家人的呼唤没有相应的反应，早晨起来后往往不能回忆。脑电图检查无特殊发现。该患者最可能的诊断是
A. 梦魇
B. 夜惊
C. 分离性障碍
D. 睡行症
E. 神经衰弱

正确答案：B。夜惊

解析：该儿童近年来常常在睡眠中突然惊叫醒来，表情恐惧，呼吸急促，出汗，持续数分钟，难以唤醒，早晨起来后往往不能回忆，脑电图正常，故诊断为夜惊（B对）。梦魇的患者能清晰回忆梦境恐怖内容，与本例不符（A错）。睡行症（梦游症）患者在睡眠过程尚未清醒时起床在室内或户外行走，或做一些简单活动的睡眠和清醒的混合状态，本例无此症状，故不考虑（D错）。